各年龄阶段之乳牙龋病发生的部位特征是
A. 1～2岁，主要发生于上颌乳前牙的唇面和邻面
B. 3～4岁，多发于乳磨牙的邻面
C. 4～5岁，好发于乳磨牙（牙合）面的窝沟
D. 6岁左右，好发于乳磨牙（牙合）面的窝沟和邻面
E. 以上都对

正确答案：A。1～2岁，主要发生于上颌乳前牙的唇面和邻面

解析：本题考查乳牙龋病。各年龄阶段乳牙龋病发生的部位有明显的特点。1～2岁时，主要发生于上颌乳前牙的唇面和邻面（A对）；3～4岁时，多发的是乳磨牙（牙合）面的窝沟（B错）；4～5岁时，好发于乳磨牙的邻面（C错）。6岁左右（D错）患龋率有所上升，但没有明显的龋病发生部位特点。